借助油相对药物分子的扩散产生屏障作用而缓释的是
A. 膜控包衣型
B. 渗透泵型
C. 乳剂分散型
D. 注射混悬液型
E. 骨架分散型

正确答案：C。乳剂分散型

解析：本题考查的是缓释、控释制剂的类型。借助油相对药物分子的扩散产生屏障作用而缓释的是乳剂分散型（C对）。根据延缓、控制药物释放原理的不同，缓释、控释制剂的类型又可分为骨架分散型、膜控包衣型、乳剂分散型、注射用油溶液或混悬液以及缓释膜剂等缓释制剂。常见的缓释、控释制剂：1）骨架型缓释、控释制剂（E错）：将药物分散在水溶性、脂溶性或不溶性骨架材料中，药物靠扩散、溶蚀作用或扩散与溶蚀共同作用而释放药物的一类缓释、控释制剂。常用的骨架材料有：①水溶性骨架材料；②脂溶性骨架材料；③不溶性骨架材料。2）膜控包衣型（A错）缓释、控释制剂：主要有缓释的微囊、微球、微丸等。常通过控制包衣膜厚度、膜孔的孔径及其弯曲度等来达到延缓与控制药物释放速度的目的。3）乳剂分散型缓释制剂：水溶性药物可制成W/O型乳剂，借助油相对药物分子的扩散具有一定的屏障作用而达到缓释目的。4）注射用缓释制剂：系将药物制成油溶液型或混悬液型（D错）注射剂。注入人体后油中药物或混悬药物粒子，向注射部位体液中分配或溶解的延缓作用而达到缓释目的。5）缓释膜剂：系指将药物包裹在多聚物薄膜隔室内，或溶解分散在多聚物膜片中而制成的缓释膜状制剂。多聚物膜对药物的释放具有延续作用。6）渗透泵式（B错）控释制剂：系指利用渗透压原理制成的控释制剂，能均匀恒速地释放药物。由于胃肠道中的离子不能通过半透膜，故渗透泵型片剂的释药速度与pH无关，在胃与小肠中的释药速度相等。7）胃滞留型缓释、控释制剂：系指通过黏附、漂浮或膨胀等作用定位（滞留）于胃中释放药物的口服定位释药系统，又称胃内滞留给药系统。可以提高主要在胃内及十二指肠部位吸收的药物的生物利用度；提高药物在胃及十二指肠部位的局部治疗效果。